关于注射剂质量要求，说法正确的是
A. 注射剂中的降压物质应符合规定
B. 溶液型注射液的可见异物应符合规定
C. 用量大、供静脉注射的注射剂应具有比血浆低的渗透压
D. 注射剂应具有必要的物理、化学及生物学稳定性
E. 注射剂的pH应和血液pH相等或相近，一般控制在4～9的范围

正确答案：A、B、D、E。注射剂中的降压物质应符合规定；溶液型注射液的可见异物应符合规定；注射剂应具有必要的物理、化学及生物学稳定性；注射剂的pH应和血液pH相等或相近，一般控制在4～9的范围

解析：本题考查注射剂的质量要求。注射剂的质量要求：1.注射剂的pH应和血液pH相等或相近（E对）；2.对用量大、供静脉注射的注射剂应具有与血浆相同的或略偏高的渗透压；3.注射剂要具有必要的物理稳定性和化学稳定性（D对），以确保产品在贮存期内安全、有效；4.注射剂必须对机体无毒性、无刺激性，降压物质必须符合规定（A对），确保安全；5.溶液型注射液应澄明，不得含有可见的异物或不溶性微粒（B对）。